男，7岁。右下后牙疼痛1周，脸肿3天。检查：大面积龋坏，叩痛（+++），龈颊沟变浅，扪及波动感，扪痛（+++），近中（牙合）面深龋洞，叩诊（-），温度测试同对照牙。X线显示：Ⅳ根分歧大面积低密度影，远中根吸收2/3，恒牙胚囊不连续，上方骨板模糊不清。龋近髓，骨硬板连续。初诊治疗方法是拔除引液，经过初诊治疗后，还应该选择
A. 制作间隙保持器
B. 完善根管治疗
C. 拔除，制作间隙保持器
D. 观察间隙
E. 氢氧化钙充填根管，暂时行使功能

正确答案：A。制作间隙保持器

解析：本题考查间隙保持器的适应证。在初诊治疗中已拔除患牙，剩下牙齿间隙，而继承恒牙又不会很快萌出，因此需要制作间隙保持器（A对），来保持早失牙齿的近远中和垂直间隙，防止邻牙向缺隙部位倾斜和对颌牙伸长。在初诊治疗中已拔除患牙，不会出现拔除患牙（C错）、根管治疗（B错）和氢氧化钙充填根管（E错）这三项操作。因患者才7岁，继承恒牙大约2～3年后才会萌出，单纯观察间隙（D错）会导致邻牙向缺隙部位倾斜和对颌牙的伸长。